患者月经一月两行，量多，色深红，质粘稠，口干，舌质红，苔黄，脉滑数，其证候是
A. 阳盛血热证
B. 气虚证
C. 血虚证
D. 气滞血瘀证
E. 肾虚证

正确答案：A。阳盛血热证

解析：患者月经一月两行，量多，色深红，质粘稠，口干，舌质红，苔黄，脉滑数符合月经先期阳盛血热证的表现（A对），阳胜则热，热扰冲任、胞宫，冲任不固，经血妄行，故月经提前来潮、经量增多；血为热灼，故经色深红或紫红，质粘稠；热邪扰心则心烦；热甚伤津则口干；小便黄，大便燥；面赤，舌红，苔黄，脉数，均为热盛于里之象。月经先期气虚证的主要证候：月经周期提前，或经量多，色淡红，质清稀；神疲肢倦，气短懒言舌淡红，苔薄白，脉细弱（B错）。月经先期肾虚证的主要证候：周期提前，经量或多或少，头晕耳鸣，腰膝酸软脉沉细（E错）。（CD错）。